《药品生产质量管理规范》（GMP）认证制度是国家对药品生产企业进行监督抽查的一种手段，下列不属于GMP认证程序的是
A. 申请、受理
B. 现场检查
C. 飞行检查
D. 审批与发现

正确答案：C。飞行检查

解析：本题考查GMP认证程序。GMP认证程序包括：申请提出、形式审查、形式审查、现场检查、审批与发证（C错，为本题正确答案）。